测定醋酸地塞米松注射液含量的依据是
A. 酸性溶液中析出白色沉淀
B. 与氯化三苯四氮唑试液反应显红色
C. 与三氯化铁试液反应呈草绿色
D. 与亚硝基铁氰化钠反应显蓝紫色
E. 与亚硒酸反应呈绿色，渐变蓝色

正确答案：B。与氯化三苯四氮唑试液反应显红色

解析：本题考查醋酸地塞米松的含量测定。皮质激素类药物在强碱性条件下可将四氮唑盐，如氯化三苯四氮唑（TTC）还原成红色，可用比色法测定含量（B对）。